肾母细胞瘤的组织学特征是
A. 角化
B. 胞质透明
C. 梭状
D. 形状，大小不等
E. 包括间叶组织的细胞，上皮细胞，和幼稚细胞

正确答案：E。包括间叶组织的细胞，上皮细胞，和幼稚细胞

解析：在肾母细胞瘤中，镜下可见到间叶组织的细胞、上皮样细胞和幼稚细胞三种细胞成分，其余选项不属于肾母细胞瘤的组织学特征（E对ABCD错）。